根据《中华人民共和国药品管理法》，医疗机构配制制剂不需要
A. 质量管理组织
B. 配置管理、质量管理的各项制度
C. 销售记录
D. 检验仪器
E. 卫生条件

正确答案：C。销售记录

解析：本题考查医疗机构设立制剂室的许可。根据《中华人民共和国药品管理法》，医疗机构配制制剂不需要销售记录（C错，为本题正确答案）。《医疗机构制剂配制监督管理办法（试行）》第二章医疗机构设立制剂室的许可第六条：医疗机构配制制剂，必须具有能够保证制剂质量的人员（A对）、设施、检验仪器（D对）、卫生条件（E对）和管理制度（B对）。